三尖瓣附于
A. 右房室口
B. 冠状窦口
C. 主动脉口
D. 肺动脉口
E. 左房室口

正确答案：A。右房室口

解析：右房室口（A对）周围有三尖瓣附着于三尖瓣环，为右心室流入道的入口。